生药呈不规则结节状拳形团块，直径2～7cm，表面深黄棕色，粗糙皱缩，有较密集而略隆起的环状轮节，并有多数瘤状突起的茎痕，顶端凹洼状。质坚实。纵切而形似蝴蝶，有错综纹理，随处可见黄色油点。具有以上性状特征的生药是
A. 川芎
B. 白术
C. 木香
D. 当归
E. 苍术

正确答案：A。川芎

解析：本题考查的是川芎饮片的性状鉴别。生药呈不规则结节状拳形团块，直径2～7cm，表面深黄棕色，粗糙皱缩，有较密集而略隆起的环状轮节，并有多数瘤状突起的茎痕，顶端凹洼状。质坚实。纵切而形似蝴蝶，有错综纹理，随处可见黄色油点。具有以上性状特征的生药是川芎（A对）。川芎：【性状鉴别】药材呈不规则结节状拳形团块。表面黄褐色或褐色，粗糙皱缩，有多数平行隆起的轮节，顶端有凹陷的类圆形茎痕，下侧及轮节上有多数小瘤状根痕。质坚实，不易折断，断面黄白色或灰黄色，可见波状环纹（形成层）及错综纹理，散有黄棕色小油点（油室）。气浓香，味苦、辛，稍有麻舌感、微回甜。饮片为不规则厚片，外表皮黄褐色或褐色，有皱缩纹。横切片切面黄白色或灰黄色，散有黄棕色小油点，可见明显波状环纹或多角形纹理。纵切片边缘不整齐，呈蝴蝶状，习称“蝴蝶片”，切面灰白色或黄白色，散有黄棕色小油点。质坚实，气浓香，味苦、辛、微甜。白术（B错）：【性状鉴别】药材呈不规则的肥厚团块。表面灰黄色或灰棕色，有瘤状突起及断续的纵皱和沟纹，并有须根痕，顶端有残留茎基和芽痕。质坚硬，不易折断，断面不平坦，黄白色至淡棕色，有棕黄色的点状油室散在；烘干者断面角质样，色较深，或有裂隙。气清香，味甘、微辛，嚼之略带黏性。木香（C错）：【性状鉴别】药材呈圆柱形或半圆柱形。表面黄棕色至灰褐色，有明显的皱纹、纵沟及侧根痕。质坚，不易折断，断面灰褐色至暗褐色，周边灰黄色或浅棕黄色，形成层环棕色，有放射状纹理及散在的褐色点状油室。气香特异，味微苦。当归（D错）：【性状鉴别】药材略呈圆柱形，下部有支根。表面浅棕色至棕褐色，具纵皱纹及横长皮孔样突起。根头（归头）具环纹，上端圆钝，或具数个明显突出的根茎痕，有紫色或黄绿色的茎及叶鞘的残基；主根（归身）表面凹凸不平；支根（归尾）上粗下细，多扭曲，有少数须根痕。质柔韧，断面黄白色或淡棕黄色，皮部厚，有裂隙及多数棕色点状分泌腔，木部色较淡，形成层环黄棕色。有浓郁的香气，味甘、辛、微苦。苍术（E错）：【性状鉴别】药材茅苍术呈不规则连珠状或结节状圆柱形，略弯曲，偶有分枝。表面灰棕色，有皱纹、横曲纹及残留的须根，顶端具茎痕或残留的茎基。质坚实，断面黄白色或灰白色，散有多数棕红色或橙黄色油点（油室），习称“朱砂点”，暴露稍久，可析出白色细针状结晶。气香特异，味微甘、辛、苦。